一职工从沿海某城市归来，腹泻1天，10余次，水样便，到市医院求治，疑为肠炎，后便培养出E1-Tor型细菌。诊断后11小时医师上报疫情，国家要求上报此类传染病最迟不超过
A. 6小时
B. 2小时
C. 18小时
D. 24小时
E. 48小时

正确答案：B。2小时